属于主动转运的的肾排泄过程是
A. 肾小管分泌
B. 肾小球滤过
C. 肾小管重吸收
D. 胆汁排泄
E. 乳汁排泄

正确答案：A。肾小管分泌

解析：本题考查药物的排泄。肾小管分泌（A对）是一个主动转运的的肾排泄过程，主要发生在近曲小管；肾小球滤过（B错）是当血流通过肾小球时，与血浆蛋白结合的药物不能通过肾小球滤过膜，仍滞留于血流中；而游离型药物，只要分子大小适当，可经肾小球滤过膜进入原尿；肾小管重吸收（C错）方式为简单扩散；胆汁排泄（D错）包括被动转运和主动转运；乳汁排泄（E错）不属于肾排泄。